对偏态分布的计量资料，为较好地代表其平均水平应该用
A. 均数
B. 几何均数
C. 中位数
D. 百分位数
E. 众数

正确答案：C。中位数

解析：中位数：是一组由小到大按顺序排列的观察值中位次居中的数值，用M表示。在全部观察值中，小于和大于中位数的观察值个数相等。可用于描述任何分布，特别是偏态分布资料以及频数分布的一端或两端无确切数据资料的中心位置。掌握“定量资料的统计描述和推断”知识点。